男，45岁。反复肝功能异常多年，尿少双下肢水肿2年，加重2周。口服呋塞米20mg，3次/日，尿量由500ml/d增至3500ml/d。1天来昏睡，呼之有反应，患者意识障碍最可能的原因是
A. 脑血管意外
B. 肝肺综合征
C. 肝性脑病
D. 肝肾综合征
E. 低血容量性休克

正确答案：C。肝性脑病

解析：中年男性患者，反复肝功能异常多年（有发展为肝硬化的可能，肝硬化为肝性脑病最常见的病因），尿少、双下肢水肿2年，加重2周（肝功能减退使抗利尿激素灭活减少，引起水钠潴留），口服呋塞米后尿量由500ml/d增至3500ml/d（大量排钾利尿为肝性脑病的常见诱因），一天来昏睡，呼之有反应（肝性脑病3期表现），综上，患者意识障碍最可能的原因是肝性脑病（C对）。脑血管意外（A错）多见于老年人，常有高血压、高脂血症等病史。肝肺综合征（P410）（B错）主要表现为严重肝病、肺内血管扩张、低氧血症三联征。肝肾综合征（P409）是指发生在严重肝病基础上的肾衰竭，表现为少尿、无尿和氮质血症。低血容量性休克（九版外科学P33）（E错）主要表现为血压降低、心率加快、尿量减少。